“血海”是指
A. 任脉
B. 督脉
C. 冲脉
D. 带脉
E. 足阳明经

正确答案：C。冲脉

解析：冲脉涵蓄调节十二经气血，故称为血海（C对）。任脉（A错）称为“阴脉之海”；督脉（B错）称为“阳脉之海”；带脉（D错）维系约束周身经脉；胃为“水谷之海”，足阳明胃经（E错）多气多血之经。